链球菌感染形成的脓液一般为
A. 淡黄稀薄脓液
B. 翠绿色，稍黏稠，有酸臭味
C. 黄色黏稠脓液
D. 灰白或灰褐色脓液
E. 脓液稀薄污浊，似米汤，夹杂有干酪样坏死物

正确答案：A。淡黄稀薄脓液

解析：当急性炎症局限成脓肿后，由于主要感染菌种的不同，其脓液性状也有差异，链球菌一般为淡黄稀薄脓液，有时由于溶血而呈褐色。掌握“口腔颌面部感染概论”知识点。